女性，50岁，3个月前被自行车把撞伤上腹部，近3周来上腹隆起，进食后上腹胀满伴恶心、呕吐，查体：上腹部扪及18cm×13cm囊性肿块，钡餐透视见横结肠下移。最可能的诊断是
A. 胰腺囊腺瘤
B. 腹膜后血肿
C. 假性胰腺囊肿
D. 肠系膜囊肿
E. 脾包膜下血肿

正确答案：C。假性胰腺囊肿

解析：中年女性患者，上腹部自行车把撞伤史（自行车把伤、方向盘伤为胰腺损伤的常见原因），近3周出现进食后上腹胀满，伴恶心、呕吐，上腹部可扪及囊性肿块，钡餐透视见横结肠下移（提示假性胰腺囊肿），结合患者病史、体查和影像学检查，最可能的诊断为胰腺假性囊肿（C对）。假性胰腺囊肿多继发于胰腺损伤和胰腺炎，主要表现为上腹逐渐膨隆，腹胀，压迫邻近的胃、结肠可出现恶心、呕吐，影响进食。胰腺囊腺瘤（A错）、肠系膜囊肿（D错）临床均较少见，与胰腺外伤无关。腹膜后血肿（B错）多继发于骨盆及脊柱骨折，常无典型临床表现，查体肿块不易触及。脾包膜下血肿（E错）多表现为失血症状，包块位于左上腹。